男，62岁。反复无痛肉眼血尿3个月。偶伴尿频、尿急。查体：一般状态好，轻度贫血貌，双肾未触及。首先应考虑的疾病是
A. 泌尿系感染
B. 前列腺增生
C. 膀胱肿瘤
D. 膀胱结石
E. 慢性前列腺炎

正确答案：C。膀胱肿瘤

解析：患者老年男性（膀胱肿瘤好发人群），间歇性无痛肉眼血尿（泌尿系肿瘤常见典型症状）3个月。偶伴尿频、尿急（膀胱刺激症状）。查体：一般状态好，轻度贫血貌，双肾未触及（初步暂可排除肾脏病变可能）；结合患者病史和临床表现首先考虑膀胱肿瘤（C对）；泌尿系感染（A错）、膀胱结石（D错）常伴排尿疼痛或腹痛症状；前列腺增生（B错）以排尿困难为主要症状，腺体表面黏膜较大的血管破裂时，可有不同程度的无痛性肉眼血尿。慢性前列腺炎（E错）多以排尿困难为主要症状不会出现无痛性肉眼血尿。